下列哪一种因果连接方式是正确且完整的
A. 单因单果
B. 单因多果
C. 多因单果
D. 多因多果
E. 直接病因链

正确答案：D。多因多果